关于深静脉血栓形成的叙述正确的是
A. 硬膜外麻醉后较全麻后更易发生
B. 直肠癌低位前切除术后较甲状腺癌手术后更易发生
C. 胆囊切除术后较全髋置换术后更易发生
D. 术后活动过早
E. 术后镇痛药物应用过多

正确答案：B。直肠癌低位前切除术后较甲状腺癌手术后更易发生

解析：造成深静脉血栓形成的三大因素是静脉损伤、血液缓慢和血液高凝状态。手术是导致血液高凝状态的高危因素，手术创伤越大越容易导致血液高凝状态，因此各种大手术（全髋置换术、直肠癌术等）较小手术（胆囊切除术、甲状腺癌手术）术后更易发生深静脉血栓形成。此外，直肠癌低位前切除术及全髋置换术术后需较长时间卧床，引起下肢静脉血流缓慢，容易发生深静脉血栓形成。综上所述，直肠癌低位前切除术后较甲状腺癌手术后更易发生（B对）深静脉血栓；全髋置换术后较胆囊切除术后（C错）更易发生深静脉血栓。全麻后下肢完全处于松弛状态，血管充分扩张，静脉血流速度减慢，容易产生深静脉血栓；硬膜外麻醉麻醉平面呈节段性，对下肢静脉血流影响相对较小，因此硬膜外麻醉后较全麻后较少发生（A错）深静脉血栓形成。术后活动可加快静脉回流（通过骨骼肌对静脉的挤压作用，即所谓“肌肉泵”）减少静脉血栓形成（D错）。镇痛药物一般不引起深静脉血栓（E错）。